土壅木郁，体现的关系是
A. 母病及子
B. 子病及母
C. 相乘传变
D. 相侮传变
E. 母子同病

正确答案：D。相侮传变

解析：母子同病为母病及子或子病及母，母脏子脏相互影响而同病。木克土，土壅木郁即脾病及肝，不是母子间疾病的传变，是反向克制导致的传变（D对）。